某肺叶发生肺不张时，典型的X线表现是
A. 中等密度，边界不清的云絮状阴影
B. 密度增高，边缘清楚，呈散在小花朵状阴影
C. 密度增高，边缘锐利的粗乱的线条状阴影
D. 斑点状或小块状密度甚高的缴密阴影
E. 三角形密度均匀增高的片状阴影

正确答案：E。三角形密度均匀增高的片状阴影